发生慢性中毒的基本条件是
A. 毒物的剂量
B. 毒物的作用时间
C. 毒物的蓄积作用
D. 居室煤气泄漏
E. 吸毒成瘾

正确答案：C。毒物的蓄积作用